有关抗-HBs的下述论点中，哪条不正确
A. 是HBsAg的抗体
B. 为中和抗体
C. 有保护性
D. 滴度＞20U时对攻击才有免疫力
E. 在乙肝恢复期出现，持续6个月至数年

正确答案：D。滴度＞20U时对攻击才有免疫力

解析：本题考查抗HBs的作用。抗HBs，又称乙型肝炎表面抗体，是机体受HBsAg刺激而产生的相应抗体（A对），为中和抗体（B对），它可以与HBsAg相结合，在体内其他免疫系统共同作用下清除病毒，以保护机体不再受HBV的感染，具有保护性（C对），常常在乙肝恢复期出现，持续6个月至数年（E对）。乙肝表面抗体的浓度如果大于10mlU/ml（D错，为本题正确答案），对乙肝病毒就具有良好的免疫力。